五倍子、四季青、地榆与利福平联用，能
A. 引发肾功能衰竭
B. 形成络合物
C. 产生永久性结合物
D. 引发永久性耳聋
E. 引发药源性肝病

正确答案：E。引发药源性肝病

解析：本题考查的是中西药不合理联用产生的副作用。五倍子、四季青、地榆与利福平联用，能引发药源性肝病（E对）。含水合型鞣质而对肝脏有一定毒性的诃子、五倍子、地榆、四季青等，以及含有这些药物的中成药，不能与对肝脏有一定毒性的西药四环素、利福平、氯丙嗪、异烟肼、依托红霉素等联用，因联用后会加重对肝脏的毒性，导致药源性肝病的发生。引发肾功能衰竭（A错）为含乙醇的中成药与乙酰氨基酚联用的副作用。含乙醇的中成药如各种药酒等，不可与对乙酰氨基酚同服，因同用后二者的代谢产物对肝脏损害严重，有些患者对此类药极为敏感，从而可引起肝坏死及急性肾衰竭。形成络合物（B错）为含钙、镁、铁等金属离子的中药与四环素类抗生素联用的效果。含钙、镁、铁等金属离子的中药，如石膏、瓦楞子、牡蛎、龙骨、海螵蛸、石决明、赭石、明矾等及其中成药，不能与四环素类抗生素联用，因金属离子可与此类西药形成络合物，而不易被胃肠道吸收，降低疗效。产生永久性结合物（C错）为含鞣质较多的中药或中成药与维生素B₁或维生素K联用的效果。含鞣质较多的中药或中成药，不可与维生素B₁或维生素K合用，因合用后会在体内产生难以吸收的结合物，使药效降低。引发永久性耳聋（D错）为含碱性成分的中药及其制剂与氨基糖苷类西药合用的副作用。含碱性成分的中药及其制剂，不能与氨基糖苷类西药合用，因这些中药及其制剂能使机体对氨基糖苷类抗生素吸收增加，排泄减少，虽能提高抗生素的抗菌药力，但却增加了其在脑组织中的药物浓度，使耳毒性作用增强，从而影响前庭功能，导致暂时或永久性耳聋及行动蹒跚。